在气的生成和水液代谢方面关系密切的是
A. 心与肺
B. 心与肾
C. 肺与脾
D. 脾与肝
E. 肺与肝

正确答案：C。肺与脾

解析：肺与脾的关系，主要表现在气的生成与津液代谢两个方面（C对）：①气的生成：肺主呼吸，吸入自然界清气；脾主运化水谷，化生水谷精气。清气与水谷精气合为宗气，宗气与元气合为一身之气。后天之气的盛衰，主要取决于宗气的生成。脾化生的水谷精微依赖肺气宣降以输布全身，肺的生理功能所需水谷精微又依靠脾气运化以成。故有“肺为主气之枢，脾为生气之源”之说。②津液代谢：肺气宣降主行水，使津液正常输布与排泄；脾主运化水饮，上输于肺，或脾气散精，使津液正常生成与输布。肺脾两脏协调配合，相互为用，是保证津液正常输布与排泄的重要环节。心与肺的关系主要体现为气与血的关系（A错）。心与肾的关系，主要表现为水火既济、精神互用、君相安位等方面（B错）。脾与肝的关系，主要表现在疏泄与运化的相互为用、藏血与统血的相互协调关系（D错）。肺与肝的关系，主要体现在调节人体气机升降方面（E错）。